浙贝母粉末置紫外光灯（365nm）下观察，荧光颜色是
A. 蓝紫色
B. 橙红色
C. 黄棕色
D. 亮淡绿色
E. 亮黄色

正确答案：D。亮淡绿色